某女，35岁。胃痛胀满，嗳腐恶食。矢气后痛减，医生辨为饮食停滞证，治宜选用的中成药是
A. 良附丸
B. 保和丸
C. 左金丸
D. 四神丸
E. 健脾丸

正确答案：B。保和丸

解析：本题考查的是胃痛的辨证论治。胃痛胀满，嗳腐恶食。矢气后痛减，医生辨为饮食停滞证，治宜选用的中成药是保和丸（B对）。胃痛又称胃脘痛，是以上腹胃脘部近心窝处疼痛为主要表现的疾病。（一）寒邪客胃证：【中成药应用】常用中成药有良附丸（A错）、安中片（素片）、仲景胃灵丸。（二）饮食伤胃证：【中成药应用】常用中成药有槟榔四消丸（大蜜丸）、开胸顺气丸、沉香化滞丸、加味保和丸。（三）肝气犯胃证：【中成药应用】常用中成药有沉香化气丸、朴沉化郁丸、舒肝健胃丸、舒肝和胃丸（大蜜丸）、调胃舒肝丸。（四）湿热中阻证：【中成药应用】常用中成药有木香槟榔丸、中满分消丸、胃痛宁片。（五）胃阴亏耗证：【中成药应用】常用中成药有胃尔康片、胃乐新颗粒、胃安胶囊、阴虚胃痛颗粒。（六）脾胃虚寒证：【中成药应用】常用中成药有黄芪健胃膏、温胃舒胶囊、胃疡灵颗粒、虚寒胃痛胶囊。四神丸（D错）为泄泻肾阳虚衰证的中成药应用。泄泻肾阳虚衰证：【中成药应用】常用中成药有四神丸、桂附理中丸、固本益肠片、肠胃宁片。健脾丸（E错）为积滞脾虚夹积证的方剂应用。积滞脾虚夹积证：【中成药应用】常用中成药有健胃消食片、小儿胃宝丸。中成药应用为左金丸（C错）的病证，2022年考试指南未明确说明。